不参与咽淋巴环构成的结构有
A. 咽鼓管扁桃体
B. 咽后淋巴结
C. 腭扁桃体
D. 舌扁桃体
E. 咽扁桃体

正确答案：B。咽后淋巴结

解析：咽鼓管扁桃体(A对)、腭扁桃体(C对)、舌扁桃体(D对)、咽扁桃体(E对)共同构成咽淋巴环，咽后淋巴结(B错，为本题正确答案)位于咽后壁和椎前筋膜之间，不参与构成咽淋巴环。